制备倒凹的目的主要是
A. 有利于充填
B. 有利于垫底
C. 有利于放置盖髓剂
D. 有利于获得良好的固位形
E. 有利于获得良好的抗力形

正确答案：D。有利于获得良好的固位形

解析：倒凹固位：倒凹是一种机械固位，在洞底的侧髓线角或点角处平洞底向侧壁牙本质作出的潜入小凹，有时也可沿线角作固位沟。充填体突入倒凹或固位沟内，防止充填体从垂直方向脱位。掌握“银汞充填窝洞的概念”知识点。